呋塞米的不良反应包括
A. 低血钾
B. 低血容量
C. 低血钠
D. 低血镁
E. 低血糖

正确答案：A、B、C、D。低血钾；低血容量；低血钠；低血镁

解析：本题考查呋塞米的不良反应。呋塞米过度利尿可引起水、电解质紊乱，表现为低血容量（低血压）（B对）、低血钾（A对）、低血钠（C对）、低氯性代谢性碱血症，长期应用还可引起低镁血症（D对），尤其是饮食摄入不足者，补充含有镁盐成分的制剂可以纠正。呋塞米可引起高血糖（E错），但很少导致糖尿病。